丙酮酸氧化脱羧生成的物质是
A. 丙酰CoA
B. 乙酰CoA
C. 羟基戊二酰CoA
D. 乙酰乙酰CoA
E. 琥珀酰CoA

正确答案：B。乙酰CoA